全身最大的扁肌是
A. 腹直肌
B. 腹外斜肌
C. 背阔肌
D. 胸大肌
E. 无

正确答案：C。背阔肌

解析：全身最大的扁肌是背阔肌（C对）。